子宫动脉来自
A. 腹主动脉
B. 髂总动脉
C. 髂内动脉
D. 髂外动脉
E. 肾动脉

正确答案：C。髂内动脉

解析：子宫动脉来自髂内动脉（C对），是髂内动脉前干分支，在腹膜后沿骨盆侧壁向下向前行，经阔韧带基底部、宫旁组织到达子宫外侧，发出分支分布于宫底、宫体、卵巢、宫颈及阴道上段。腹主动脉（A错）发出分支形成卵巢动脉。髂总动脉（B错）分为髂内动脉和髂外动脉，髂外动脉（D错）分支分布于下肢。肾动脉（E错）与子宫动脉无关。